能引起变态反应的粉尘是
A. 沥青粉尘
B. 石棉粉尘
C. 谷物尘
D. 大麻尘
E. 水泥粉尘

正确答案：D。大麻尘